患者右上腹痛，阵发性加剧，并向右肩部放射，伴有恶心呕吐黄疸舌苔黄腻脉滑数，针灸取穴除阳陵泉胆囊穴胆俞日月外，应对证加用
A. 中脘、天枢
B. 梁丘、太冲
C. 内庭、阴陵泉
D. 太冲、丘墟
E. 肩井、内关

正确答案：C。内庭、阴陵泉

解析：患者右上腹痛，阵发性加剧，并向右肩部放射，伴有恶心呕吐黄疸舌苔黄腻脉滑数，诊为胆绞痛之肝胆湿热证。胆绞痛治疗治宜疏肝利胆、行气止痛，以胆的俞穴、募穴、下合穴为主。主穴选用胆囊、阳陵泉、胆俞、日月，肝胆湿热配行间、内庭、阴陵泉。经外奇穴胆囊为治疗胆腑疾病的经验效穴。阳陵泉为胆之下合穴，可调理胆腑气机。胆俞、日月同用，俞募相配，利胆止痛。行间属足厥阴肝经，为足厥阴肝经荥穴，主泻肝经火热。内庭穴归属足阳明胃经，有泻火、理气止痛等作用。阴陵泉属足太阴脾经，功用健脾利湿、益气固本，主诸湿证。三穴合用，共清湿热（C对）。